下列哪项是固本止崩汤的组成药物
A. 人参、黄苗、白术、熟地黄、当归、干姜
B. 人参、黄芪、白术、熟地黄、当归、生姜
C. 人参、黄芪、白术、生地黄、当归、干姜
D. 人参、黄芪、白术、熟地黄、当归、黑姜
E. 人参、黄芪、白术、生地黄、当归、黑姜

正确答案：D。人参、黄芪、白术、熟地黄、当归、黑姜

解析：固本止崩汤的功效为补气摄血，固冲止崩，由熟地黄、 人参、 黄芪、 白术、 当归、 黑姜组成，方歌：固本止崩术归参，地芪姜炭止血崩，若决江河错不醒，养血益气固其真（D对）。